酸中毒
A. 启动内源性凝血系统
B. 启动外源性凝血系统
C. 两者都是
D. 两者都不是
E. 无

正确答案：C。两者都是

解析：内源性凝血系统被激活（C对ABDE错）出现在酸中毒时，损伤血管内皮细胞，导致胶原暴露，激活FXⅡa，启动内源性凝血系统。